治疗成人癫痫部分发作的首选药物是
A. 乙琥胺
B. 硫酸镁
C. 苯巴比妥
D. 扑米酮
E. 苯妥英钠

正确答案：E。苯妥英钠

解析：治疗成人癫痫部分发作的首选药物是卡马西平和苯妥英钠（E对）（6神经病学P306）。乙琥胺（A错）是治疗癫痫小发作的首选药物。硫酸镁（B错）静脉滴注主要用于缓解子痫、破伤风等惊厥。苯巴比妥（D错）主要用于治疗癫痫大发作和癫痫持续状态（C错）。扑米酮仅用于其他药物无效。